女，28岁。婚后4年未孕，月经周期4～5天/2～3个月，量偏少，身高156cm，体重75kg，面部可见痤疮，阴毛分布呈男性型。妇科检查：子宫未见异常，双侧卵巢稍大。基础体温单相。该患者用氯米芬的治疗，最需要注意防止的并发症是
A. 卵巢早衰
B. 卵巢过度刺激综合征
C. 肝肾功能损害
D. 盆腔炎性疾病
E. 黄素化卵泡不破裂综合征

正确答案：B。卵巢过度刺激综合征

解析：成年女性患者，婚后4年未孕，月经周期4～5天（正常值3～7天）/2～3个月（正常值21～35天），量偏少，身高156cm，体重75kg，面部可见痤疮，阴毛分布呈男性型。妇科检查：子宫未见异常，双侧卵巢稍大。基础体温单相。可计算出该患者的BMI约为31，大于28，为肥胖。综合患者的症状、体征，该患者最可能的诊断是多囊卵巢综合征。氯米芬可诱发排卵，该患者用氯米芬的治疗，最需要注意防止的并发症是卵巢过度刺激综合征（B对）。氯米芬是诱发排卵的药物，卵巢早衰（A错）、肝肾功能损害（C错）、盆腔炎性疾病（D错）、黄素化卵泡不破裂综合征（E错）均不是最需要注意防止的并发症。